吴茱萸汤的功用是
A. 温中补虚，理气健脾
B. 温中补虚，和里缓急
C. 温中散寒，降逆止痛
D. 温中补虚，降逆止呕
E. 温中补虚，散寒止痛

正确答案：D。温中补虚，降逆止呕

解析：吴茱萸汤方中吴茱萸上可温胃散寒，下可温暖肝肾，又能降逆止呕；生姜温胃散寒，降逆止呕。佐以甘温之人参，补益中焦脾胃之虚；佐使以甘平之大枣，益气补脾，调和诸药。四药相伍，共奏温中补虚、降逆止呕之功。（D对）。理中丸的功用为温中祛寒，补气健脾（A错）。小建中汤的功用为温中补虚，和里缓急（B错）。大建中汤的功用为温中补虚，缓急止痛（C错）。大黄附子汤的功用为温里散寒，通便止痛（E错）。